损伤下列哪一结构，症状发生于病灶的同侧
A. 内侧丘系
B. 三叉丘系
C. 薄束、楔束
D. 脊髓丘脑束
E. 外侧丘系

正确答案：C。薄束、楔束

解析：损伤丘系交叉之前的结构会导致症状发生于病灶的同侧。丘系交叉参与躯干和四肢意识性本体感觉的精细触觉的传导通路。该通路第2级神经元的胞体在薄、楔束核内，由此二核发出的纤维向前绕过中央灰质的腹侧，在中线上与对侧的交叉，形成丘系交叉，所以损伤丘系交叉之前的结构，即薄束核和楔束（C对），症状发生于病灶的同侧。